患者外感风寒，恶寒发热，无汗，腹痛，吐泻，舌苔白腻。治疗宜选用
A. 麻黄
B. 桂枝
C. 香薷
D. 防风
E. 白芷

正确答案：C。香薷

解析：该题考查香薷的临床应用。外感风寒，恶寒发热，无汗，治以外解风寒，腹痛，吐泻，舌苔白腻，治以内化湿浊。香薷辛温发散具有发汗解表的功效，且其气芳香，入脾胃又能化湿和中而祛暑，故香薷多用于风寒感冒而兼脾胃湿困者（C对）。麻黄具有发散风寒，宣肺平喘，利水消肿的功效，宜用于风寒外郁，腠理密闭无汗的外感风寒表实证，没有化湿和中之功（A错）。桂枝具有发汗解肌，温通经脉，助阳化气的功效，善于宣阳气于卫分，畅营血于肌表，没有化湿和中之功（B错）。防风具有祛风解表，胜湿止痛，止痉的功效，不长于散寒，没有化湿和中之功（D错）。白芷具有解表散寒，祛风止痛，通鼻窍，燥湿止带，消肿排脓的功效，祛风解表之力较温和，而以止痛、通鼻窍见长，没有化湿和中之功（E错）。